口服可用于治疗肠道感染和肠道术前准备的药物是
A. 青霉素
B. 红霉素
C. 氯霉素
D. 庆大霉素
E. 磺胺嘧啶

正确答案：D。庆大霉素

解析：口服庆大霉素可用于胃肠道术前消毒、治疗肠道感染、幽门螺旋杆菌引起的慢性胃炎及消化性溃疡（D对）。